尖锐器械伤害的处理方法不当的是
A. 用肥皂液和流动水清洗污染的皮肤，用生理盐水冲洗污染的黏膜
B. 被注射器扎伤时只需简单的处理即可，无需采用药物预防
C. 受伤部位的伤口冲洗后，用消毒液进行消毒，并包扎伤口
D. 发生职业暴露后，立即报告医院感染管理科
E. 高风险时采用药物预防

正确答案：B。被注射器扎伤时只需简单的处理即可，无需采用药物预防

解析：尖锐器械伤害的处理：当尖锐器械伤害发生时，受害者须保持冷静，如果尖锐器械与患者有关，要先留下患者，然后按照尖锐器械伤害的急救与处理进行：①用肥皂液和流动水清洗污染的皮肤，用生理盐水冲洗污染的黏膜。②受伤部位的伤口冲洗后，用消毒液（75%乙醇或0.5%碘伏）进行消毒，并包扎伤口：被暴露的黏膜，反复用生理盐水冲洗干净。③发生职业暴露后，立即报告医院感染管理科，填写职业暴露以便进行调查、监控、随访。④高风险时采用药物预防，如被HBV阳性患者血液、体液污染的锐器损伤，应在24小时内注射高价乙肝免疫球蛋白，同时进行血液乙肝标志物检查，阴性者皮下注射乙肝疫苗10μg、5μg、5μg（按0个月、1个月、6个月间隔）。掌握“患者、医务人员及环境的防护”知识点。